患者，女，57岁，BMI31.2，诊断为2型糖尿病，经生活方式干预，未能有效控制血糖，肝肾功能未见异常，初始治疗首选的药物是
A. 二甲双胍
B. 吡格列酮
C. 阿卡波糖
D. 格列齐特
E. 西格列汀

正确答案：A。二甲双胍

解析：本题考查二甲双胍。由题干可知该患者BMI为31.2，属于肥胖，且诊断为2型糖尿病，应首选二甲双胍（A对）进行治疗。吡格列酮（B错）用于2型糖尿病的控制与改善，不是该患者首选药物。阿卡波糖（C错）配合饮食控制，用于治疗糖尿病，或降低糖耐量低减者的餐后血糖，不是该患者首选药物。格列齐特（D错）用于经饮食控制及体育锻炼2～3个月疗效不满意的轻、中度2型糖尿病（非胰岛素依赖型糖尿病）患者，不是该患者首选药物。西格列汀（E错）用于改善2型糖尿病患者的血糖控制，不是该患者首选药物。